Ⅰ型糖尿病患者首选的药物是
A. 胰岛素
B. 格列喹酮
C. 二甲双胍
D. 普伐他汀
E. 阿卡波糖

正确答案：A。胰岛素

解析：本题考查降糖药。Ⅰ型糖尿病患者的胰岛素分泌不足，治疗首选胰岛素注射（A对）。格列喹酮（B错）可作为糖尿病合并肾病者首选。二甲双胍（C错）用于2型肥胖型糖尿病患者。普伐他汀（D错）适用于饮食限制仍不能控制的原发性高胆固醇血症或合并有高甘油三酯血症患者。阿卡波糖（E错）为单纯餐后血糖高的糖尿病患者首选。